迷走神经兴奋引起胰液分泌特点是
A. 水少，盐和酶多
B. 水多，盐和酶少
C. 水少，酶少，盐多
D. 水多，盐多，酶少
E. 水少，盐少，酶多

正确答案：E。水少，盐少，酶多